马尾组成主要是
A. 腰、骶、尾神经根围绕得终丝而形成
B. 骶神经根绕终丝而形成
C. 骶、尾神经根围绕终丝而形成
D. 腰神经根围绕终丝而形成
E. 腰、骶神经根围绕终丝而形成

正确答案：A。腰、骶、尾神经根围绕得终丝而形成

解析：马尾主要是由腰L、骶S、尾C神经根围绕得终丝而形成（A对）。